患者阵发性胃脘部绞痛，揉按则舒，上腹部平软。治疗应首选
A. 原穴
B. 络穴
C. 下合穴
D. 八会穴
E. 背俞穴

正确答案：C。下合穴

解析：下合穴（C对）主要用于治疗六腑疾病。《灵枢·邪气脏腑病形》指出“合治内腑”，临床上六腑相关的疾病常选其相应的下合穴治疗。本患者阵发性胃脘部绞痛，揉按则舒，说明病位在胃，为六腑之病，故选用下合穴。原穴（A错）是脏腑原气输注、经过和留止于十二经脉四肢部的的穴，又称“十二原”，是人体生命活动的原动力，为十二经脉维持正常生理功能之根本，主要用于治疗相关脏腑的疾病；络穴（B错）既可治疗其络脉的病证，又可治疗表里两经的病证；八会穴（D错）虽属于不同经脉，但对于各自所会的脏、腑、气、血、筋、脉、骨、髓相关的病证有特殊的治疗作用，临床上常把其作为治疗这些病证的主要穴位；背俞穴（E错）和募穴都是脏腑之气输注和会聚的部位，在分布上大体与对应的脏腑所在部位的上下排列相接近，主要用于治疗相关脏腑的病证。